急性肝衰竭最多见的病因是
A. 化学性中毒
B. 病毒性肝炎
C. 肾功能不全
D. 烧伤
E. 妊娠高血压综合征

正确答案：B。病毒性肝炎

解析：急性肝衰竭（AHF）最多见的病因是病毒性肝炎（B对）。化学物中毒（A错），如对乙酰氨基酚，是国外急性肝衰竭的常见病因。肾功能不全（C错）、烧伤（D错）、妊娠高血压综合症（E错）也可引发急性肝衰竭，但并不多见。